糖尿病型牙周病的特征为
A. 易发生牙周脓肿
B. 易有牙髓并发病变
C. 牙周手术后愈合快
D. 病变发展缓慢
E. 牙龈肥大组织增生

正确答案：A。易发生牙周脓肿

解析：本题考查糖尿病型牙周病的特征。糖尿病型牙周病的特征为易发生牙周脓肿（A对）。糖尿病本身并不引起牙周炎，而是由于该病的基本病理变化，如小血管和大血管病变、免疫反应低下、中性多行核白细胞功能低下、胶原分解增加而合成减少等，使牙周组织对局部致病因子的抵抗力下降，因而导致牙周病的破坏加重、病变进展加速（D错），易发生牙周脓肿；但这种病理变化并不能作用于牙髓组织，故不易并发牙髓病变（B错）。糖尿病会减缓伤口愈合的速度，使牙周病手术后愈合慢（C错）。糖尿病型牙周病易发生牙周脓肿，不易发生牙龈肥大组织增生（E错）。